分泌降钙素的细胞是
A. 甲状旁腺细胞
B. 甲状腺滤泡细胞
C. 甲状腺滤泡旁细胞
D. 破骨细胞
E. 成骨细胞

正确答案：C。甲状腺滤泡旁细胞

解析：分泌降钙素的细胞是甲状腺滤泡旁细胞（C对），又称C细胞。甲状旁腺细胞（A错）分泌甲状旁腺素。甲状腺滤泡细胞（B错）即甲状腺滤泡上皮细胞，分泌甲状腺激素。破骨细胞（D错）主要分泌有机酸，如柠檬酸、乳酸等；以及多种蛋白酶，如组织蛋白酶和基质金属蛋白酶，不分泌降钙素。成骨细胞（E错）主要分泌骨胶纤维、有机基质以及部分细胞因子，如成纤维细胞生长因子、胰岛素样生长因子、破骨细胞刺激因子等。